下列免疫球蛋白能够进入胎儿体内的是
A. IgA
B. IgM
C. IgG
D. IgE
E. IgD

正确答案：C。IgG

解析：免疫球蛋白是介导体液免疫的重要效应分子，是B细胞接受抗原刺激后增殖分化为浆细胞所产生的糖蛋白，主要分为IgM、IgA、IgD、IgE、IgG。其中，IgG（C对）的分子量最小，是唯一可以通过血胎屏障的抗体，在新生儿抗感染免疫中起重要作用。